血栓闭塞性脉管炎寒湿证的治法是
A. 清热解毒，活血化瘀
B. 活血通络，散寒止痛
C. 清热活血，疏通经络
D. 温阳通脉，祛寒化湿
E. 清热解毒，化痰通络

正确答案：D。温阳通脉，祛寒化湿

解析：血栓闭塞性脉管炎寒湿证的治疗应温阳通脉，祛寒化湿（D对）。